纵膈畸胎瘤好发部位是
A. 前上纵膈
B. 后上纵膈
C. 前纵膈
D. 后纵膈
E. 中纵膈

正确答案：C。前纵膈

解析：临床上以胸骨角与第四胸椎下缘的水平线为界，将纵隔分为上、下两部。下纵隔再以心包前后界分为前、中、后三部分。上纵隔（AB错）常见的肿瘤有胸骨后甲状腺肿、胸腺瘤等；前纵隔（C对）常见的肿瘤为畸胎瘤和皮样囊肿；中纵膈（E错）常见的肿瘤为心包囊肿；后纵隔（D错）常见的肿瘤为神经源性肿瘤。